孕妇开始自觉胎动的时间是
A. 妊娠15～17周
B. 妊娠18～20周
C. 妊娠21～22周
D. 妊娠23～24周
E. 妊娠27周以上

正确答案：B。妊娠18～20周

解析：胎动一般在妊娠18周后B型超声检查可发现，妊娠20周初孕妇可感觉到胎动，经产妇感觉略早于初产妇（B对）。